药品监督管理部门没收药品、违法所得，并处罚款，被处罚人不服提起诉讼，此类案件由人民法院哪个审判庭审理
A. 民事审判庭
B. 刑事审判庭
C. 经济审判庭
D. 行政审判庭
E. 军事审判庭

正确答案：D。行政审判庭

解析：本题考查药品监督管理。药品监督管理部门没收药品、违法所得，并处罚款，被处罚人不服提起诉讼，此类案件由人民法院的行政审判庭（D对）审理。